苯巴比妥的作用是
A. 镇痛作用
B. 抗炎作用
C. 两者皆有
D. 两者皆无

正确答案：D。两者皆无

解析：本题考查苯巴比妥。苯巴比妥小剂量可引起镇静，抗焦虑；中等剂量可催眠，因易产生耐受性和依赖性已不作为镇静催眠药常规使用；大剂量时可抗惊厥；苯巴比妥还是癫痫大发作及癫痫持续状态首选药，无镇痛和抗炎作用（D对ABC错）。